可能接触铅的作业是
A. 喷漆
B. 焊接
C. 铸字
D. 炸药生产
E. 染料生产

正确答案：C。铸字